患者女，1岁6个月，因感冒发热到医院就诊，医生处方对乙酰氨基酚滴剂，药师误发成对乙酰氨基酚片，患者家属拿到药品后不知如何使用，故询问药师，此时药师发现发错了药。针对该类型差错，有效的防范措施是
A. 采用电子处方系统
B. 双人核对
C. 使用药片通用名
D. 采用两种方式核对患者身份
E. 交代药品贮存条件

正确答案：B。双人核对

解析：本题考查用药错误。针对该类型差错，有效的防范措施是双人核对（B对）。本题中药师发药错误属于调剂错误，有效的防范措施是药师坚持核对，规范操作。在配药时由训练有素的护士或其它医务工作者观察给药全过程，并与医嘱信息对比。